患者症见“太阳病，关节疼痛而烦，脉沉而细”，又见“小便不利，大便反快”，此为
A. 太阳中风
B. 血痹
C. 伤寒
D. 历节
E. 湿痹

正确答案：E。湿痹

解析：湿痹本是湿邪侵犯太阳之表，并流注关节筋脉为主的一种病证，故以关节烦疼为特征（E对）。倘患者脾胃功能虚弱，或外湿内趋。则会形成内外混相合的证候。本条就属于这种情况。湿邪内阻，影响膀胱气化则小便不利。湿趋大肠则大便反快。若内湿不去，则阳气被遏，难以祛除外湿，故但当利其小便。小便得利则内湿去，阳气通，有助于祛除外湿。